通草的功效是
A. 祛风止痒
B. 清肺止咳
C. 破血通经
D. 凉血止血
E. 通气下乳

正确答案：E。通气下乳

解析：本题考查通草的功效。通草的功效是通气下乳（E对）。通草【功效】利水清热，通气下乳。地肤子【功效】利尿通淋，祛风止痒（A错）。枇杷叶【功效】清肺止咳（B错），降逆止呕。瞿麦【功效】利尿通淋，破血通经（C错）。马齿苋【功效】清热解毒，凉血止血（D错），通淋。